某地一项关于交通安全问题的研究发现，去年交通事故的驾驶员中有61%有10年以上的驾驶经验，21%有6～10年的驾驶经验，只有17%的驾驶员有1至5年的驾驶经验。因此推测：可能是由于司机自以为有了经验，麻痹大意，导致发生事故，这个推论之所以不够正确是因为下列哪种原因
A. 率未经年龄标化
B. 资料不完整，因为有部分交通事故未上报
C. 还需要那些未发生交通事故司机们的有关资料加以对比
D. 没有进行统计学显著性检验
E. 不仅要计算发生率还需计算流行率

正确答案：C。还需要那些未发生交通事故司机们的有关资料加以对比

解析：本题考查设立对照的必要性。当面对一些疾病自然史不清楚的疾病，其“疗效”也许是疾病发展的自然结果，不设立可比的对照组（C对ABDE错），则很难与治疗措施的真实疗效区分开来。题中的事故与驾龄的关系中，未设立对照组，因此该研究的结果缺乏说服力。